梅毒黏膜斑表现为
A. 红棕色光滑斑块
B. 棕黄色光亮斑块
C. 灰白色光亮斑块
D. 灰白色角化斑块
E. 黄白色灰暗斑块

正确答案：C。灰白色光亮斑块

解析：本题考查梅毒黏膜斑的表现。梅毒黏膜斑是二期梅毒最常见的口腔损害，可发生在口腔的任何部位，以舌最多见，其次为咽、扁桃体、颊及腭，损害呈灰白色光亮斑块（C对），圆形或椭圆形，直径为1厘米，边界清楚。灰白色角化斑块（D错）是口腔白斑病的斑块状病损的表现，口腔白斑病的主要病理变化是上皮增生，伴有过度正角化或过度不全角化，口腔黏膜上出现白色或灰白色均质型斑块。口腔白色角化病也为灰白色角化斑块。